选择性沉积在牙齿和骨骼中，不可用于8岁以下患儿的药物是
A. 氟喹诺酮类
B. 大环内酯类
C. 氨基糖苷类
D. 四环素类
E. 酰胺醇类(氯霉素）

正确答案：D。四环素类

解析：本题考查四环素类。选择性沉积在牙齿和骨骼中，不可用于8岁以下患儿的药物是四环素类（D对）。四环素类与钙离子形成的螯合物沉积于牙齿和骨中，造成牙齿黄染，并影响胎儿、新生儿和婴幼儿骨骼的正常发育。氟喹诺酮类（A错）可致肌痛、骨关节病损、跟腱炎症和跟腱断裂。大环内酯类（B错）可引起药疹和药物热，偶可引起过敏和暂时性耳聋。氨基糖苷类（C错）药物都有不同程度的耳毒性、肾毒性和神经肌肉阻滞作用。酰胺醇类(氯霉素）（E错）可致不可逆性的骨髓功能抑制，引起再生障得性贫血，儿童需慎用。